某医师为了评价某疫苗的效果，将人群随机分成两组，一组为接种组，给子疫苗接种；另一组为对照组，不接种疫苗。经过一个流行期后，对两组发病情况进行比较，这种方法属于
A. 现况研究
B. 病例对照研究
C. 定群研究
D. 实验研究
E. 横断面研究

正确答案：D。实验研究